甲亢性心脏病中，最常见的心律失常是
A. 室上性心动过速
B. 室性早搏
C. 房室交界性早搏
D. 心房颤动
E. 心房扑动

正确答案：D。心房颤动

解析：甲亢性心脏病中，最常见的心律失常是心房颤动（D对），甲亢患者中10%~15%发生心房颤动，甲亢患者发生心力衰竭时，30%~50%与心房颤动并存。室上性心动过速（A错）通常无器质性心脏病表现，不同性别与年龄均可发生；室性早搏（B错）常见于高血压、冠心病、风湿性心脏病以及二尖瓣脱垂等；房室交界性早搏（C错）既可见于正常健康人，也可见于器质性心脏病，多见于风湿性心脏病、心肌炎、心肌病、冠心病等；心房扑动（E错）常见于风湿性心脏病、冠心病、高血压性心脏病、心肌病等，甲状腺功能亢进也可发生心房扑动，但不如房颤常见。